Ⅱ型呼吸衰竭的血气诊断标准是
A. PaO₂＜50mmHg，PaCO₂＞45mmHg
B. PaO₂＜50mmHg，PaCO₂＞60mmHg
C. PaO₂＜60mmHg，PaCO₂＞50mmHg
D. PaO₂＜40mmHg，PaCO₂＞40mmHg
E. PaO₂＜70mmHg，PaCO₂＞55mmHg

正确答案：C。PaO₂＜60mmHg，PaCO₂＞50mmHg

解析：呼吸衰竭是指各种原因引起的肺通气和（或）换气功能严重障碍，使静息状态下亦不能维持足够的气体交换，导致低氧血症伴（或不伴）高碳酸血症，进而引起一系列病理生理改变和相应临床表现的综合征。呼吸衰竭按照动脉血气分类，可分为I型呼吸衰竭和Ⅱ型呼吸衰竭。Ⅱ型呼吸衰竭即低氧血症并伴有CO₂的潴留，血气分析特点是PaO₂＜60mmHg，同时伴有PaCO₂＞50mmHg”（C对ABDE错）。